肛周脓肿的穿刺液是
A. 不凝的血性液体
B. 黄绿色透明液体，无臭味
C. 稀脓性液体，略带臭味
D. 淡黄色透明液体
E. 黄绿色稠厚液体，带有粪便样特殊臭味

正确答案：E。黄绿色稠厚液体，带有粪便样特殊臭味

解析：肛周脓肿穿刺液：黄绿色粘稠液体，带粪便特殊臭味 急性阑尾炎穿孔：稀脓性液体，略带臭味（E对）。